放置宫内节育器应注意的事项不包括
A. 术后休息3日
B. 术后2周禁性交及盆浴
C. 术后月经来潮注意节育器有无脱落
D. 术后未见尾丝应行超声检查
E. 带铜节育器可放置5年

正确答案：E。带铜节育器可放置5年

解析：放置宫内节育器应注意的事项包括：1.术后休息3日（A对），1周内忌重体力劳动，2周内忌性交及浴盆（B对）；2.保持外阴清洁；3.三个月内大便或经期，应注意节育器有无脱落（C对）；4.对子宫糜烂或放置时操作时间长者，给予抗炎治疗；5.定期随访；6.若术后在宫颈口处未见尾丝，需考虑节育器异位的可能，因此术后未见尾丝应行超声检查（D对）。带铜节育器可放置5～7年，E选项说法正确，但这不是放置宫内节育器的注意事项（E错，为本题正确答案）。